上颌第二乳磨牙和下颌第二乳磨牙形态各与同颌的哪一颗牙形态近似
A. 第一恒磨牙
B. 第二恒磨牙
C. 第三恒磨牙
D. 第一前磨牙
E. 第二前磨牙

正确答案：A。第一恒磨牙

解析：本题考查乳牙外形。上颌第二乳磨牙和下颌第二乳磨牙形态各与同颌的第一恒磨牙（A对）形态近似。上颌乳中切牙与上颌恒中切牙形态相似；上颌乳侧切牙与上颌恒侧切牙形态相似；下颌乳中切牙与下颌恒中切牙牙冠外形相似；下颌乳侧切牙与下颌恒侧切牙的外形相似；上颌乳尖牙外形与上颌恒尖牙相似；下颌乳尖牙外形与下颌恒尖牙相似；上颌第一乳磨牙形态似上颌前磨牙；下颌第一乳磨牙是唯一一颗不类似任何恒牙的乳牙；上颌第二乳磨牙与下颌第二乳磨牙分别与同颌的第一恒磨牙形态近似，位置彼邻。